中国药典（1995年版）规定的“阴凉处”是指
A. 放在阴暗处，温度不超过2℃
B. 放在阴暗处，温度不超过10℃
C. 避光，温度不超过20℃
D. 温度不超过20℃
E. 放在室温避光处

正确答案：D。温度不超过20℃

解析：本题考查药品的贮存。标明“阴凉处”贮存则应贮存在不超过20℃的环境中（D对E错）。标明在“凉暗处”贮存则贮存温度不超过20℃并遮光保存（ABC错）。标明在冷处贮存则应贮存在2℃～10℃环境中。一般药品贮存于室温10℃～30℃即可。